以下关于大隐静脉的描述，不正确的是
A. 起于足背静脉网内侧部
B. 伴腓肠神经走行
C. 经踝关节前方
D. 行于深筋膜的浅面
E. 在耻骨结节外下方注入股静脉

正确答案：B。伴腓肠神经走行

解析：大隐静脉在足内侧缘起自足背静脉弓（A对）。伴股神经（B错，为本题正确答案）走行。经踝关节前方（C对）。行于深筋膜的浅面（D对）。在耻骨结节外下方注入股静脉（E对）。